下列哪项属于比较声称用语
A. 含有
B. 增加
C. 高
D. 低
E. 无

正确答案：B。增加